作用于DNA拓扑异构酶Ⅱ的抗肿瘤药物是
A. 来曲唑
B. 依托泊苷
C. 卡莫氟
D. 紫杉醇
E. 顺铂

正确答案：B。依托泊苷

解析：本题考查作用于DNA拓扑异构酶Ⅱ的抗肿瘤药物。依托泊苷（B对）是作用于DNA拓扑异构酶Ⅱ的抗肿瘤药物。来曲唑（A错）为芳构酶抑制剂；卡莫氟（C错）为嘧啶类抗代谢药；紫杉醇（D错）为干扰有丝分裂的抗肿瘤药物；顺铂（E错）的是金属配合物抗肿瘤药。